青霉素G的主要不良反应是
A. 肾损害
B. 过敏
C. 听力减退
D. 肝损害
E. 胃肠道反应

正确答案：B。过敏

解析：青霉素G的不良反应：1.变态反应，即过敏反应（B对），为青霉素类最常见的不良反应，以Ⅱ型即溶血性贫血、药疹、接触性皮炎、间质性肾炎、哮喘和ⅡⅠ型即血清病样反应较多见，但多不严重，停药后可消失。最严重的是Ⅰ型即过敏性休克。2.赫氏反应。3.其他不良反应。青霉素G的不良反应不包括肾损害（A错）、听力减退（C错）、肝损害（D错）、胃肠道反应（E错）。